男，60岁，1年行经尿道膀胱肿瘤电切术，病理诊断为高级别尿道上皮瘤，后未随访，3天因肉眼血尿两次入院，膀胱镜查发现膀胱肿瘤复发，直径3cm，病理诊断仍为高级别尿道上皮瘤，盆腔CT提示肿瘤侵及膀胱全层。最佳的治疗方案是
A. 膀胱部分全切术
B. 经尿道肿瘤电切术
C. 膀胱根治性切除术
D. 化疗＋支持治疗
E. 化疗＋放疗＋支持治疗

正确答案：C。膀胱根治性切除术

解析：老年男性患者，曾患膀胱肿瘤治疗后未随访，现因膀胱癌复发，病理诊断为高级别尿道上皮瘤，直径3cm，肿瘤侵及膀胱全层，表明已达T3期，最佳的治疗方法为根治性膀胱全切除术（C对）。膀胱部分切除术（A错）适用于T2、T3期低级别、局限的肿瘤或病人不能耐受膀胱全切者。经尿道膀胱肿瘤电切术（B错）主要用于Ta、T1期肿瘤。部分非肌层浸润性膀胱癌分化良好，长期无发展，可行化疗药物膀胱灌注治疗（D错）。放疗或化疗（E错）也可用于T4期失去手术机会的膀胱癌。关于不同临床分期膀胱癌的治疗现总结如下：Tis（原位癌）可行化疗药物或卡介苗（BCG）膀胱灌注治疗。Ta、T1期肿瘤行经尿道膀胱肿瘤电切术（TURBt），术后行膀胱灌注化疗。T2期低级别、局限的肿瘤可经尿道切除或行膀胱部分切除术。T3期低级别、单个局限、如病人不能耐受膀胱全切者可采用膀胱部分切除术；膀胱浸润性癌行根治性膀胱全切除术。T4期肌层浸润性癌常失去根治性手术机会，采用姑息性放化学治疗。